根据《药品经营质量管理规范》，在药品批发企业中，质量管理工作人员应当具备的最低学历或资质要求是
A. 具有大学本科以上学历、执业药师资格和三年以上药品经营质量管理工作经历
B. 具有预防医学、药学、微生物学或者医学等专业大学本科以上学历
C. 具有药学或者医学、生物、化学相关专业中专以上学历
D. 具有药学中专或者医学、生物、化学等相关专业大学专科以上学历

正确答案：D。具有药学中专或者医学、生物、化学等相关专业大学专科以上学历

解析：本题考查的是药品批发企业经营和质量管理人员的资质要求。根据《药品经营质量管理规范》，在药品批发企业中，质量管理工作人员应当具备的最低学历或资质要求是具有药学中专或者医学、生物、化学等相关专业大学专科以上学历（D对）。药品批发企业质量管理工作人员：具备药学中专或者医学、生物、化学等相关专业大学专科以上学历或者具有药学初级以上专业技术职。药品批发企业企业质量负责人：具有大学本科以上学历、执业药师资格和3年以上药品经营质量管理工作经历（A错），在质量管理工作中具备正确判断和保障实施的能力。负责疫苗质量管理和验收工作的专业技术人员：从事疫苗配送的企业应当配备至少2名专业技术人员专门负责疫苗质量管理和验收工作，专业技术人员应当具有预防医学、药学、微生物学或者医学等专业本科以上学历（B错）及中级以上专业技术职称，并有3年以上从事疫苗管理或者技术工作经历。药品批发企业验收、养护工作人员：具有药学或者医学、生物、化学等相关专业中专以上学历（C错）或者具有药学初级以上专业技术职称。